药学工作人员在直接面对服务对象时，应当遵守的职业道德规范包括
A. 仁爱救人，文明服务
B. 济世为怀，清廉正派
C. 严谨治学，理明术精
D. 谦让谨慎，独立创新
E. 宣传医药知识，承担治疗保健职责

正确答案：A、B、C。仁爱救人，文明服务；济世为怀，清廉正派；严谨治学，理明术精